男性，25岁。主诉心前区疼痛2小时，向左肩放射，吸气时疼痛加重，坐位时减轻，伴有畏寒、发热就诊，体检：血压105/75mmHg，体温38度，心率110次/分，规则，心脏无杂音，两肺未见异常，有血吸虫病史。心电图示除aVR与V₁外各导联ST段抬高。此时作X线检查可能显示
A. 左肺野楔状实质性阴影，伴左胸腔积液
B. 正常
C. 肺部无明显充血而心影显著增大
D. 左肺野多发炎症阴影
E. 两侧肺门影不大

正确答案：C。肺部无明显充血而心影显著增大

解析：患者青年男性，心前区疼痛2小时，向左肩放射，吸气时疼痛加重，坐位时减轻（急性心包炎的典型胸痛特点），伴有畏寒发热（提示可能有病毒感染）；心电图示除aVR与V₁外各导联ST段抬高（急性心包炎常见的心电图表现），根据患者的急性起病、典型胸痛和心电图表现，其最可能的诊断是急性心包炎。此时作X线检查可能显示正常（B对），肺部常无明显充血，若同时合并大量心包积液，则可见心影显著增大（C对）。因此本例存在争议，BC选项应该都符合题意，但原给出答案为C。左肺野楔状实质性阴影，伴左胸腔积液（A错）可见于肺梗死等疾病，常由肺楔状梗死造成。左肺野多发炎症阴影（D错）多见于肺部炎症疾病，如支气管肺炎的X线检查结果示沿支气管分布的片状密度增高阴影。两侧肺门影不大（E错）常见于胸膜炎、气胸等非炎性疾病。